关于革兰染色，叙述错误的是
A. 革兰阳性菌染成深紫色
B. 染色顺序为结晶紫→95%乙醇→碘液→稀释复红
C. 革兰阴性菌染成红色
D. 具有鉴别细菌意义
E. 具有指导选择抗菌药物的意义

正确答案：B。染色顺序为结晶紫→95%乙醇→碘液→稀释复红